下列各项，不属传染病基本特征的是
A. 有病原体
B. 有感染后免疫性
C. 有流行病学特征
D. 有发热
E. 有传染行性

正确答案：D。有发热

解析：传染病基本特征为：有病原体（A对）、有传染性（E对）、有流行病学特征（C对）及感染后免疫（B对）。而发热属于传染病的临床特征之常见症状和体征（D错，为本题正确答案）。